男，35岁。近2个月频繁出现入睡困难、多梦易醒、醒后难以再入睡，白天精力疲乏，影响日常生活工作。每周至少发生3次。最常用的药物治疗是
A. 米氮平
B. 曲唑酮
C. 喹硫平
D. 阿米卡星
E. 艾司唑仑

正确答案：E。艾司唑仑

解析：患者中年男性，近2月频繁出现入睡困难、多梦易醒、醒后难以再入睡，白天精力疲乏，影响日常生活工作。每周至少发作3次（典型的失眠症临床表现）。失眠症主要使用苯二氮䓬类药物治疗，常用的苯二氮䓬类药物有地西泮、氯氮䓬、硝西泮、阿普唑仑、艾司唑仑（E对）等。米氮平（A错）和曲唑酮（B错）都为抗抑郁药物，主要用于抑郁患者。喹硫平（C错）为第二代抗精神病药物，主要用于治疗精神分裂症和预防精神分裂症的复发。阿米卡星（D错）是一种氨基糖苷类抗生素，主要用于革兰阴性杆菌引起的各种感染。